关于牙周现病史，哪一项不正确
A. 发病的时间、过程及可能的诱因
B. 此次患病的治疗经过
C. 牙龈出血、牙周脓肿出现的情况
D. 父母是否患有牙周炎
E. 口腔卫生情况

正确答案：D。父母是否患有牙周炎

解析：本题考查牙周病的病史收集-现病史。关于牙周现病史不正确的是父母是否患有牙周炎（D错，为本题的正确答案）。父母是否患有牙周炎属于家族史中的内容，并非现病史。现病史包括主诉及自觉症状，病情演变过程，以及发病的时间、过程（A对）；着重在现阶段的情况如牙龈出血、牙周脓肿出现的情况（C对）以及患者自己认为可能的病因及诱发因素（A对），如口腔卫生情况（E对），曾作何治疗及其疗效；同时此次患病的治疗经过（B对）也包含在内，以方便下次治疗理解病情及其治疗。